阳虚与气虚的症状主要区別是
A. 有无少气懒言
B. 小便是否清长
C. 有无神疲乏力
D. 寒象是否明显
E. 舌质是否淡嫩

正确答案：D。寒象是否明显

解析：气虚是气的推动、固摄、防御、气化功能失常，阳虚是机体阳气虚衰，除气虚的表现外，还有气的温煦功能失司的表现。气推动功能失常则少气懒言（A错）、神疲乏力（C错）、舌质淡嫩（E错），气化功能失常则小便清长（B错）。明显寒象见于阳气温煦功能失常（D对）。